与口腔扁平苔藓鉴别诊断无关的疾病是
A. 盘状红斑狼疮
B. 白斑
C. 类天疱疮
D. 剥脱性龈炎
E. 白塞病

正确答案：E。白塞病

解析：口腔扁平苔藓的鉴别诊断：①盘状红斑狼疮；②白斑；③口腔红斑；④粘膜天疱疮、类天疱疮、剥脱性龈炎；⑤苔藓样反应；⑥多形性红斑。掌握“口腔扁平苔藓”知识点。